月季花除了活血调经外，还可
A. 疏肝解郁
B. 破血行气
C. 解蛇虫毒
D. 消肿生肌
E. 接骨疗伤

正确答案：A。疏肝解郁

解析：本题考查的是月季花的功效。月季花除了活血调经外，还可肝解郁（A对）。月季花：【功效】活血调经，疏肝解郁。莪术：【功效】破血行气（B错），消积止痛。五灵脂：【功效】活血止痛，化瘀止血，解蛇虫毒（C错）。乳香：【功效】活血止痛，消肿生肌（D错）。自然铜：【功效】散瘀止痛，接骨疗伤（E错）。